植物神经（或植物神经）系统是指
A. 躯体运动神经
B. 躯体感觉神经
C. 内脏运动神经
D. 内脏感觉神经
E. 无

正确答案：C。内脏运动神经

解析：根据周围神经终末支分布部位的特点将其分为躯体神经和内脏神经，躯体运动神经（A错）及躯体感觉神经（B错）属于前者；后者分为内脏感觉神经（D错）和内脏运动神经，因内脏运动神经（C对）主要是控制和调节动、植物共有的物质代谢活动，并不支配动物所特有的骨骼肌的运动，所以也称植物神经系统。